对附睾的描述中，正确的是
A. 为男性生殖腺
B. 贴附于睾丸的前缘
C. 可分为头、体、尾3部分
D. 附睾头向上移行为输精管
E. 分泌的液体不参与组成精液

正确答案：C。可分为头、体、尾3部分

解析：男性生殖腺（A错）为睾丸，附睾为输精管道。附睾紧贴睾丸上端和后缘（B错）。附睾可分为头、体、尾3部分（C对）。附睾尾向后上（D错）弯曲移行为输精管。附睾分泌附睾液营养精子，促进精子进一步成熟，参与（E错）组成精液。